能够引起排卵后基础体温升高的是
A. 黄体生成素
B. 卵泡刺激素
C. 雌激素
D. 孕激素
E. 催乳素

正确答案：D。孕激素

解析：本题考查卵巢性激素的合成及分泌。能够引起排卵后基础体温升高的是孕激素（D对）。黄体生成素（A错）主要功能是排卵前促使卵母细胞最终成熟及排卵。卵泡刺激素（B错）参与调节优势卵泡的选择与非优势卵泡的闭锁退化，在卵泡晚期与雌激素协同，诱导颗粒细胞生成LH受体，为排卵及黄素化做准备。雌激素（C错）主要生理功能为促进子宫肌细胞增生和肥大，使肌层增厚，增进血运，促使和维持子宫发育，增加子宫平滑肌对缩宫素的敏感性；使子宫内膜腺体和间质增生、修复；使宫颈口松弛、扩张，宫颈黏液分泌增加，性状变稀薄，富有弹性，易拉成丝状；促进输卵管肌层发育及上皮的分泌活动，并可加强输卵管肌节律性收缩的振幅；使阴道上皮细胞增生和角化，黏膜变厚，并增加细胞内糖原含量，使阴道维持酸性环境。催乳素（E错）主要功能为促进乳汁分泌。